下列不良事件中，属于假劣药事件的是
A. “康泰克PPA事件”
B. “万络（罗非昔布）事件”
C. “亮菌甲素事件”
D. “拜斯亭（西立伐他汀）事件”
E. “阿糖胞苷儿科事件”

正确答案：C。“亮菌甲素事件”

解析：本题考查假劣药事件。“亮菌甲素事件”（C对）是由于用二甘醇代替丙二醇进行生产药品，属于假劣药事件。